现时寿命表
A. 受人群数量的影响
B. 不能进行不同地区间的比较
C. 受人口年龄别构成的影响
D. 是各年龄别死亡率的综合反映
E. 是死亡年龄的平均数

正确答案：D。是各年龄别死亡率的综合反映

解析：本题考查现时寿命表。现时寿命表的数据来源于横断面观察，以获得的某年（或某一时期内）所有年龄组死亡率为已知数据（D对ABCE错），然后人为假定同时出生的一代人（一般为10万人），按照这些年龄组死亡率先后死去，直至全部死亡，分别计算出这一代人在不同年龄组的“死亡概率”“死亡人数”“尚存人数”及“期望寿命”等指标，由此编制出现时寿命表。